急性苯中毒主要损害的是
A. 骨骼系统
B. 血液系统
C. 神经系统
D. 消化系统
E. 呼吸系统

正确答案：C。神经系统

解析：急性苯中毒后会损害细胞膜结构，影响细胞膜蛋白功能，干扰细胞膜的脂质和磷脂代谢，抑制细胞膜功能，导致中枢神经麻醉，轻者产生头痛、头晕，重者恶心、呕吐、心率慢、血压高、精神异常甚至昏迷、死亡（C对）。